具有解痉镇痛、解有机磷中毒和散瞳作用的生物碱是
A. 莨菪碱
B. 苦参碱
C. 麻黄碱
D. 去甲乌药碱
E. 汉防己甲素

正确答案：A。莨菪碱

解析：本题考查的莨菪碱的主要药理作用。具有解痉镇痛、解有机磷中毒和散瞳作用的生物碱是莨菪碱（A对）。莨菪碱为洋金花的主要成分，属于莨菪烷类生物碱。现代药理研究表明，莨菪碱及其外消旋体阿托品具有解痉镇痛、解有机磷中毒和散瞳等作用。苦参碱（B错）为苦参的主要成分，属于双稠哌啶类生物碱。苦参总生物碱具有抗肿瘤、抗病原微生物、抗心律失常、解热、抗炎、抗变态反应和调节免疫等作用。麻黄碱（C错）为麻黄的主要成分，属于有机胺类生物碱。麻黄生物碱具兴奋中枢神经系统及强心、升高血压的作用。去甲乌药碱（D错）为乌头的主要成分，属于苄基异喹啉类生物碱。具有强心作用。汉防己甲素（E错）为防己的主要化学成分，属于双苄基异喹啉类生物碱。防己生物碱具有抗炎、镇痛、抗肿瘤的作用等，同时具有调节免疫力和耐缺氧的作用等。